治疗风湿日久，伤及肝肾的最佳药物组合是
A. 羌活独活
B. 秦艽薏苡仁
C. 苍术黄柏
D. 桑寄生五加皮
E. 苍术白术

正确答案：D。桑寄生五加皮

解析：风湿日久，易损肝肾；肝肾虚损，风寒湿邪又易犯腰膝部位，故选用祛风湿强筋骨药物有扶正祛邪、标本兼顾的意义。桑寄生具有祛风湿，补肝肾，强筋骨，安胎元的功效；五加皮具有祛风除湿，补益肝肾，强筋壮骨，利水消肿的功效；两药合用是治疗风湿日久，伤及肝肾的最佳药物组合（D对ABCE错）。